甲状腺术后最危急的并发症是
A. 甲状腺危象
B. 喉返神经损伤
C. 喉上神经损伤
D. 手足抽搐
E. 呼吸困难和窒息

正确答案：E。呼吸困难和窒息

解析：甲状腺手术后最危急的并发症是呼吸困难和窒息（E对），多发生在术后48小时内，如不及时发现、处理，则可危及病人生命。甲状腺危象（A错）为甲亢术后的严重并发症，表现为高热、脉快，同时合并神经、循环及消化系统严重紊乱，亦需及时处理，但不如呼吸困难危急。单侧喉返神经损伤（B错）可引发声音嘶哑，可由健侧声带部分代偿而恢复发音，并非危急并发症；双侧喉返神经损伤甚至可引起失声或严重的呼吸困难，甚至窒息，需立即作气管切开，属危急并发症。喉上神经损伤（C错）可引起声带松弛、音调降低以及饮水呛咳，并非术后最危险的并发症。手足抽搐（D错）多由甲状旁腺功能减退导致的低血钙引起，保守治疗无效可行甲状旁腺移植，不是术后最危急的并发症。